下列最符合心脏压塞诊断的是
A. 心浊音界向两侧扩大
B. 胸闷、气短症状
C. 胸骨左缘3、4肋间闻及刮擦样音
D. Ewart征
E. 心音遥远、脉压小、颈静脉怒张、低血压

正确答案：E。心音遥远、脉压小、颈静脉怒张、低血压

解析：心脏压塞的临床特征为Beck三联征（E对）：低血压、心音低弱、颈静脉怒张，最符合心脏压塞诊断。Ewart征（心包积液征）只能证明有心包积液。心浊音界向两侧扩大（A错），胸闷、气短症状（B错），胸骨左缘3、4肋间闻及刮擦样音（C错），Ewart征（D错）均不是心脏压塞的特异性症状。